X线表现呈“M”或“V”形，是哪一类型骨折的特征性表现
A. 上颌骨骨折
B. 下颌骨骨折
C. 眶底骨折
D. 颧弓骨折
E. 颅底骨折

正确答案：D。颧弓骨折

解析：颧弓骨折X线特征性表现呈“M”或“V”形。掌握“颧骨及颧弓、眼眶骨折及骨折愈合过程”知识点。